肺炎球菌肺炎典型的痰色
A. 砖红色
B. 铜绿色
C. 暗红色
D. 咖啡色
E. 铁锈色

正确答案：E。铁锈色

解析：肺炎球菌肺炎典型症状为发热、胸痛，痰色是铁锈色（E对），发病前常有受凉淋雨、疲劳、醉酒等诱因，起病急骤，伴高热寒战，胸痛，并可放射至肩部和腹部，咳嗽咳痰，可带血或呈铁锈色；食欲差，偶有恶心、腹痛或腹泻，可被误诊为急腹症。砖红色痰（A错）提示克雷白杆菌肺炎；铜绿色（B错）痰提示绿脓杆菌感染；暗红色痰（C错）提示可能有支气管扩张症；咖啡色（D错）痰可能有肺结核。